下列说法错误的是
A. LD₁₀₀指引起一组实验动物全部死亡的最低剂量
B. LD₅₀指引起一组受试实验动物半数死亡的剂量
C. LD₀₁指一组受试实验动物中，仅引起个别动物死亡的最小剂量
D. LD₀指一组受试实验动物中，不引起动物死亡的最小剂量

正确答案：D。LD₀指一组受试实验动物中，不引起动物死亡的最小剂量

解析：本题考查毒性上限参数相关内容。LD₀（最大非致死剂量）指一组受试实验动物中，不引起动物死亡的最大剂量（D错，为本题正确答案）。LD₁₀₀（绝对致死剂量）指引起一组受试实验动物全部死亡的最低剂量（A对）。LD₅₀（半数致死剂量）指引起一组受试实验动物半数死亡的剂量（B对）。LD₀₁（最小致死剂量）指一组受试实验动物中，仅引起个别动物死亡的最小剂量（C对）。